下列哪项不是HACCP系统的内容
A. 进行危害分析
B. 确定关键控制点
C. 确定关键限值
D. 得出危害结论
E. 建立对每个关键控制点的控制情况进行监控的系统

正确答案：D。得出危害结论